既拮抗H₁受体，又抑制过敏介质释放的抗过敏药物是
A. 氯雷他定
B. 富马酸酮替芬
C. 盐酸苯海拉明
D. 盐酸西替利嗪
E. 盐酸赛庚啶

正确答案：B。富马酸酮替芬

解析：本题考查H₁受体拮抗剂的作用特点。富马酸酮替芬（B对）为强效的H₁受体阻断药，还可抑制过敏介质释放。临床上用于防治哮喘和支气管痉挛。